肺动脉干起于
A. 右心房
B. 左心房
C. 左心室
D. 右心室
E. 冠状窦

正确答案：D。右心室

解析：右心室（D对）为肺动脉干的起始部，肺动脉干在主动脉的前方向左后上方斜行，至主动脉弓的下方分为左、右肺动脉。